下列哪项能够说明一组观察值之间的变异程度，即离散度
A. 标准误
B. 标准差
C. 可信区间
D. 率
E. 构成比

正确答案：B。标准差

解析：标准差:是用来说明一组观察值之间的变异程度，即离散度。掌握“口腔健康状况调查数据的整理和统计”知识点。